酮洛芬在生物药剂学分类系统中属于第Ⅳ类，其特点是
A. 高溶解度、高渗透性
B. 低溶解度、高渗透性
C. 高溶解度、低渗透性
D. 低溶解度、低渗透性
E. 低溶解度、低解离性

正确答案：D。低溶解度、低渗透性

解析：本题考查生物学分类。第Ⅳ类药物为低溶解度、低渗透性（D对）的疏水性分子药物，体内吸收比较困难，包括特非那定、呋塞米等。